女，28岁，剖宫产术后4个月，哺乳期月经未恢复，首选的避孕措施是
A. 宫内节育环
B. 口服复方避孕药
C. 工具避孕
D. 安全期避孕
E. 紧急避孕药

正确答案：C。工具避孕

解析：该患者女，28岁，剖宫产术后4个月，哺乳期月经未恢复，许多药物能够通过乳汁进入婴儿体内，所以哺乳产妇用药需要慎重。产后哺乳期，工具避孕是首选的避孕措施（C对）。